静脉滴注过快可发生红人综合征的药品是
A. 夫西地酸
B. 磷霉素
C. 万古霉素
D. 莫西沙星
E. 氯霉素

正确答案：C。万古霉素

解析：本题考查万古霉素的不良反应。万古霉素（C对）滴速过快可致由组胺引起的非免疫性与剂量相关反应（红人综合症）。夫西地酸（A错）静脉滴注可致血栓性静脉炎和静脉痉挛。磷霉素（B错）静滴应缓慢，时间应控制在1～2小时，肝肾功能减退者应慎用。莫西沙星（D错）易引起心脏QT间期延长，静滴时应缓慢，至少1h。氯霉素（E错）典型不良反应是可发生骨髓毒性，大剂量应用于早产儿或新生儿，可引起“灰婴综合征”。